可增强肝细胞膜的防御能力起到稳定、保护和修复细胞膜作用的药物是
A. 门冬氨酸钾镁
B. 多烯磷脂酰胆碱
C. 葡醛内酯
D. 异甘草酸镁
E. 联苯双酯

正确答案：B。多烯磷脂酰胆碱

解析：本题考查多烯磷脂酰胆碱。可增强肝细胞膜的防御能力起到稳定、保护和修复细胞膜作用的药物是多烯磷脂酰胆碱（B对）；门冬氨酸钾镁（A错）为电解质补充液，门冬氨酸是体内草酰乙酸的前体，在三羧酸循环中起重要作用；葡醛内酯（C错）进入机体后可与含有羟基或羧基的毒物结合，形成低毒或无毒结合物由尿排出，有保护肝脏及解毒作用；异甘草酸镁（D错）对D-氨基半乳糖引起大鼠急性肝损伤具有防治作用，能阻止动物血清转氨酶升高，减轻肝细胞变性、坏死及炎症细胞浸润；联苯双酯（E错）适用于慢性迁延型肝炎伴有丙氨酸氨基转移酶（ALT）升高异常者；也可用于化学药物引起的ALT升高。